某研究者收集了200例某恶性肿瘤术后的随访数据，并将其整理成分组资料，现欲计算生存率，可选择
A. 确切概率法
B. 乘积极限法
C. 寿命表法
D. 最小二乘法
E. 正态近似法

正确答案：C。寿命表法